易吸湿的药物是
A. 乙醇
B. 维生素D
C. 鱼肝油乳
D. 叶酸
E. 甘油

正确答案：E。甘油

解析：易吸湿的药物有蛋白银、构橼酸铁铵、氯化钙、山梨醇、甘油（E对）、乳酸、胃蛋白酶等。